不符合肺结核活动期特点的是
A. 痰涂片找到抗酸杆菌
B. X线胸片病灶扩大
C. 病灶边缘模糊
D. 空洞形成
E. 病灶密度高，边界清楚

正确答案：E。病灶密度高，边界清楚

解析：如果诊断为肺结核，应进一步明确有无活动性，因为结核活动性病变必须给予治疗。活动性病变在胸片上通常表现为边缘模糊不清（C对）的斑片状阴影，可有中心溶解和空洞（D对），或出现播散病灶（B对）。胸片表现为钙化、硬结或纤维化，痰检查不排菌（A对），无任何症状，为无活动性肺结核（E错，为本题正确答案）。